治疗各种G-杆菌感染的主要抗菌药的是
A. 妥布霉素
B. 庆大霉素
C. 阿米卡星
D. 四环素
E. 多西环素

正确答案：B。庆大霉素

解析：庆大霉素：是治疗各种G-杆菌感染的主要抗菌药，尤其对沙雷菌属作用更强，为氨基糖苷类中的首选药。可与青霉素协同治疗严重的肺炎球菌、铜绿假单胞菌、肠球菌、葡萄球菌或草绿色链球菌感染。亦可用于术前预防和术后感染。还可局部用于皮肤、黏膜表面感染和眼、耳、鼻部感染。掌握“氨基糖苷类抗生素”知识点。